对急性牙痛患者在未明确患牙前，切忌
A. 先问全身情况
B. 先做局麻止痛
C. 先行温度测验
D. 先做患牙探诊
E. 先让服止痛药

正确答案：B。先做局麻止痛

解析：本题考查牙髓病的临床诊断程序。急性牙痛不能明确定位患牙的，多为急性牙髓炎，在这种情况下应先仔细询问病史，以获得疾病的初步印象，再结合临床检查，查找引起疼痛的病因，最后通过牙髓温度测验，验证可疑患牙。急性牙痛时止痛固然重要，但是先行局麻止痛（B错，为本题的正确答案）之后，牙齿的疼痛消失，会导致牙髓的温度测试失效，更加不能正确定位患牙。先问全身情况（A对）可以排除或发现由一些全身性疾病引起牙痛的情况，有助于进一步明确病因。先行温度测验（C对）有助于对患牙的定位。先做患牙探诊（D对）有利于发现隐匿性龋坏，若有龋洞且探痛明显则可初步确定患牙。先服用止痛药（E对）可以在一定程度上缓解疼痛却又不会影响温度测试的结果，故可以进行。